细菌性脑膜炎患者应用万古霉素治疗，快速大剂量静脉滴注后可能会产生
A. “胰岛素样自体免疫综合征”
B. “灰婴综合征”
C. “药源性流感综合征”
D. “手足综合征”
E. “红人综合征”

正确答案：E。“红人综合征”

解析：本题考查药物的滴注速度。万古霉素不宜肌内注射或直接静脉注射，滴注速度过快可致由组胺引起的非免疫性与剂量相关反应（出现“红人综合征”（E对））。胰岛素自身免疫综合征（A错）是由血中非外源性胰岛素诱导的胰岛素自身抗体及高浓度免疫活性胰岛素所致的自发性低血糖症。灰婴综合征（B错）是由大量服用氯霉素进行抗菌治疗引起的。药源性流感综合征（C错）是由药物引起的。手足综合征（D错）是一种进行性加重的皮肤病变，手较足更易受累，可由多种化疗药物引起。